治疗肝胃不和证胃炎的首选方剂是
A. 柴胡疏肝散
B. 丹栀逍遥散
C. 逍遥散
D. 六磨汤
E. 四磨饮子

正确答案：A。柴胡疏肝散

解析：胃脘胀痛或痛窜两胁，每因情志不舒而病情加重，得嗳气或矢气后稍缓，嗳气频频，口苦，口中黏腻不爽，嘈杂泛酸，舌质淡红，苔薄白，脉弦者，应用柴胡疏肝散疏肝理气，和胃止痛（A对）。丹栀逍遥散可养血健脾，疏肝清热，适用于肝郁血虚内热者（B错）。逍遥散可疏肝解郁，养血健脾，治疗肝郁血虚脾弱（C错）。六磨汤适用于气滞腹胀，胁腹痞满或腹中胀痛，便秘纳呆（D错）。四磨饮子用于肝气郁结之胸膈胀闷，上气喘急，心下痞满，不思饮食者（E错）。